代谢性酸中毒病人一般不表现为
A. 面部潮红
B. 心率加快
C. 呼吸深而快
D. 尿液呈中性
E. 呼气有酮味

正确答案：D。尿液呈中性

解析：轻度代谢性酸中毒可无明显症状。重症病人最明显的表现是呼吸变得又深又快（C对），呼出气带有酮味（E对）。病人可有面颊潮红（A对），心率加快（B对）。代谢性酸中毒时，由于机体的代偿作用，肾远曲肾小管中Na⁺、H⁺交换增多，使H⁺随尿排出增多，尿液呈酸性（D错，为本题正确答案）。